对胰岛功能丧失的患者有效的药物是
A. 甲苯磺丁脲
B. 苯乙双胍
C. 普通胰岛素
D. 精蛋白锌胰岛素
E. 珠蛋白锌胰岛素

正确答案：B、C、D、E。苯乙双胍；普通胰岛素；精蛋白锌胰岛素；珠蛋白锌胰岛素

解析：本题考查对胰岛功能丧失的患者有效的药物。对胰岛功能丧失的患者有效的药物是苯乙双胍（B对）、普通胰岛素（C对）、精蛋白锌胰岛素（D对）、珠蛋白锌胰岛素（E对）。苯乙双胍降糖机制是增加基础状态下糖的无氧降解，抑制肠道内葡萄糖的吸收，增加葡萄糖的外周利用，抑制糖原异生，抑制胰高血糖素的释放，从而降低血压。因此对胰岛功能丧失的患者仍有效。普通胰岛素、精蛋白锌胰岛素、珠蛋白锌胰岛素为作用时间不同的胰岛素制剂，降糖作用不依赖于胰岛，对胰岛功能丧失的患者仍有效。甲苯磺丁脲（A错）是通过刺激胰岛B细胞发挥作用，对胰岛功能尚存的病人有效，但对1型糖尿病病人以及切除胰腺的动物则无效。